小儿哮喘的主要内因是
A. 肺气虚弱
B. 肾不纳气
C. 瘀血阻滞
D. 脾气虚弱
E. 痰饮留伏

正确答案：E。痰饮留伏

解析：哮喘的发生都是外因作用于内因的结果，其发作之病机为内有壅塞之气，外有非时之感，膈有胶固之痰，三者相合，闭拒气道，搏击有声，发为哮喘（E对）。肺主宣发肃降，通调水道，为水上之源，肺气虚弱则水液失于输布，凝液为痰（A错）。肾为水脏，主人身水液，肾不纳气，肾气不足，不能蒸化水液，水湿泛滥为痰饮（B错）。瘀血阻滞，气机不利，三焦输布功能失常，水液化为痰饮（C错）。脾主运化水液，脾气虚弱，运化失司，聚湿为痰（D错）。究其根本，哮喘的内因痰饮隐伏于肺，当有外邪引动时发为哮喘，而形成痰饮的原因多由于肺、脾、肾三脏功能不足，但却非哮喘根本病因。